属于柯萨奇病毒显性感染的
A. 无菌性脑膜炎
B. 心肌炎
C. 手足口病
D. 疱疹性咽峡炎
E. 以上说法均正确

正确答案：E。以上说法均正确

解析：柯萨奇病毒显性感染包括无菌性脑膜炎、疱疹性咽峡炎、胸痛、心肌炎、心周炎、手足口病、急性出血性结膜炎等多种疾病。掌握“胃肠道病毒”知识点。